妊娠期龈炎的治疗，不正确的
A. 去除局部刺激物
B. 局部应用1%过氧化氢液含漱
C. 严格控制菌斑
D. 全身应用抗生素
E. 适时手术治疗

正确答案：D。全身应用抗生素

解析：对于较严重的患者，如牙龈炎症肥大明显、龈袋有溢脓时，可用1%过氧化氢液和生理盐水冲洗，也可使用刺激性小、不影响胎儿生长发育的含漱液含漱，如1%过氧化氢液，但不宜长期使用。应注意尽量避免使用全身药物治疗，以免影响胎儿发育。掌握“妊娠期龈炎”知识点。